环境卫生学所研究的环境主要包括
A. 生活环境和生产环境
B. 自然环境和劳动环境
C. 居住环境和自然环境
D. 自然环境和生活居住环境
E. 生活居住环境和生产环境

正确答案：D。自然环境和生活居住环境

解析：本题考查环境卫生学研究的环境。环境卫生学研究的环境通常包括自然环境和生活环境（D对ABCE错）。前者如大气圈、水圈、土壤岩石圈和生物圈；后者主要指人类为更好地生活而建立起来的居住、工作和娱乐环境以及有关的生活环境因素如家用化学品等。